男，36岁。心悸、怕热、手颤、乏力一年，大便不成形，3～4次/天，体重下降11公斤。查体：脉搏90次/分，血压128/90mmHg，皮肤潮湿，双手细颤，双眼突出，甲状腺弥漫Ⅱ度肿大，可闻及血管杂音，心率104次/分，律不齐，心音强弱不等，腹平软，肝脾肋下未及，双下肢无水肿。为明确诊断，首选检查是：
A. 甲状腺摄¹³¹I率
B. 血TSH，T₃，T₄
C. T₃抑制实验
D. TRH兴奋实验
E. 抗甲状腺抗体

正确答案：B。血TSH，T₃，T₄

解析：青年男性患者，出现长期心悸怕热，手颤乏力，体重下降，大便次数增多（甲状腺功能亢进症典型症状）。眼球突出，甲状腺肿大并可闻及血管杂音（甲状腺功能亢进症典型体征），因此本例考虑诊断为甲状腺功能功能亢进症。诊断甲状腺功能亢进症的首选检查为血TSH，T₃，T₄检测（B对）。甲状腺¹³¹I摄取试验（P684）（A错）为诊断甲亢的的传统方法，目前已经被sTSH（敏感TSH）测定技术所代替。T₃抑制试验（C错）主要用于弥漫性甲状腺肿伴甲亢与单纯性甲状腺肿的鉴别。TRH兴奋试验（D错）可以反映垂体对TRH的反应能力，主要用于甲状腺功能减退症的诊断（兴奋试验多适用于分泌功能减退的情况）。抗甲状腺抗体（E错）包括刺激性和抑制性两种抗体，而检测到的抗甲状腺抗体并不能反映抗体的功能状态。